全身化脓性感染的病原菌不包括
A. 革兰染色阴性杆菌
B. 革兰染色阳性杆菌
C. 无芽胞厌氧菌
D. 真菌
E. 病毒

正确答案：E。病毒

解析：全身化脓性感染的病原菌包括革兰染色阴性杆菌、革兰染色阳性杆菌、无芽胞厌氧菌以及真菌，无病毒。掌握“全身化脓性感染”知识点。